是损伤了
A. 视交叉右外侧部
B. 视交叉左外侧部
C. 视交叉中心部
D. 左侧视束
E. 内囊

正确答案：A。视交叉右外侧部

解析：当视觉传导通路的不同部位受损时，可引起不同的视野缺损： 视网膜损伤引起的视野缺损与损伤的位置和范围有关； 一侧视神经损伤可致该侧眼视野全盲； 视交叉中交叉纤维损伤可致双眼视野颞侧半偏盲； 一侧视交叉外侧部的不交叉纤维损伤，则患侧眼视野的鼻侧半偏盲，所以右眼鼻侧视野缺失, 是损伤了视交叉右外侧部（A对）；一侧视束及以后的视觉传导路（视辐射、视区皮质）受损，可致双眼病灶对侧半视野同向性偏盲（如右侧受损则右眼视野鼻侧半和左眼视野颞侧半偏盲）。